患者眩晕，耳鸣，突然发生口舌歪斜，舌强语謇，手指或半身麻木，烦躁失眠，舌红，脉弦滑。治疗应首选方剂
A. 龙胆泻肝汤
B. 地黄饮子
C. 镇肝熄风汤
D. 大秦艽汤
E. 苏合香丸

正确答案：C。镇肝熄风汤

解析：肾阴素亏，肝阳上亢故见眩晕，耳鸣；风阳内动，携痰走窜经络，经络不畅，故见突然发生口舌歪斜，舌强语謇，手指或半身麻木；肾阴不足，心肾不交故见烦躁失眠；舌红，脉弦滑均为中风阴虚风动证的表现，治疗需滋阴潜阳，镇肝熄风，方药选用镇肝熄风汤加减（C对）。龙胆泻肝汤（A错）可以清泻肝胆实火，清利肝经湿热，用于治疗肝胆实火上炎证和肝经湿热下注证。地黄饮子（B错）可以滋肾阴，补肾阳，开窍化痰，用于治疗瘖痱证。大秦艽汤（D错）可以祛风通络，养血和营，用于治疗脉络空虚，风邪入中证。苏合香丸（E错）可以行气开窍，温中止痛，用于治疗寒闭证。